乌梅的功效是
A. 敛肺、涩肠、止遗、安蛔
B. 敛肺、止带、止遗、安蛔
C. 敛肺、涩肠、生津、安蛔
D. 敛肺、涩肠、止带、安蛔
E. 敛肺、止带、止血、安蛔

正确答案：C。敛肺、涩肠、生津、安蛔

解析：乌梅为收涩药，性味酸涩，平，归肝、脾、肺、大肠经，具有敛肺、涩肠、生津、安蛔之效（C对），常用来治疗久咳、久痢、虚热消渴、蛔厥腹痛等症。